妇血康颗粒与益母草颗粒同用后，能明显提高
A. 止痛效果
B. 止带效果
C. 止泻效果
D. 止血效果
E. 止汗效果

正确答案：D。止血效果

解析：本题考查的是妇血康颗粒与益母草颗粒的功效。妇血康颗粒与益母草颗粒同用后，能明显提高止血效果（D对）。妇血康颗粒【功效】活血化瘀，止血调经。益母草颗粒【功效】活血调经。